男，40岁，查见松动I度，右上6牙合面深龋，颊侧近中探及深达根尖的牙周袋，探之溢脓，叩（-），X-ray示牙槽骨高度基本正常，根尖区阴影。初诊印象牙髓牙周联合病变，考虑原因可能为最适宜的治疗为
A. 根管治疗
B. 牙周系统治疗
C. 先做根管治疗，再做牙周系统治疗
D. 干髓治疗和牙周系统治疗
E. 直接进行牙周和根尖手术

正确答案：C。先做根管治疗，再做牙周系统治疗

解析：本题考查牙髓-牙周联合病变的治疗原则。松动I度，右上6（牙合）面深龋，颊侧近中探及深达根尖的牙周袋，且牙槽骨高度正常，可判断该患者为牙髓病变引起的牙周病变，因此应先积极的根管治疗，再进行牙周治疗（C对），不能只单纯的进行根管治疗（A错）或牙周治疗（B错）。干髓术只适用于牙髓炎的患牙，而且根髓不能受到感染，但临床上没有有效的手段来判断是否根髓被感染，且该患者为牙髓炎症引起的牙周的病变，根髓已经感染，所以不能用干髓术（D错）。